新病舌绛而颤动，伴高热惊厥的是
A. 血虚动风
B. 热极生风
C. 阴虚动风
D. 疫毒攻心
E. 肝阳化风

正确答案：B。热极生风

解析：新病舌绛而颤动者，多属热极生风（B对）。久病舌淡白而颤动者，多属血虚动风（A错）。舌红少津而颤动者，多属阴虚动风、肝阳化风（CE错）。吐舌可见于疫毒攻心，或正气已绝（D错）。